不能用于制备乳剂的方法是
A. 油中乳化剂法
B. 水中乳化剂法
C. 相转移乳化法
D. 两相交替加入法
E. 新生皂法

正确答案：C。相转移乳化法